头面部浅感觉传导通路第1级神经元是
A. 薄束核和楔束核
B. 胶状质
C. 三叉神经脊束核
D. 孤束核
E. 三叉神经节

正确答案：E。三叉神经节

解析：头面部浅感觉传导通路第1级神经元是三叉神经节（E对），第 2 级神经元的胞体在三叉神经脊束核（C错）和三叉神经脑桥核内，第 3 级神经元的胞体在背侧丘脑的腹后内侧核。躯干、四肢本体觉传导通路第 2 级神经元是薄束核和楔束核（A错）。